有牙体缺损需修复但又非嵌体适应证时最佳修复为
A. 嵌体
B. 部分冠
C. 桩核冠
D. 塑料全冠
E. 铸造金属全冠

正确答案：B。部分冠

解析：本题考查牙体缺损修复体固位及适应、禁忌证。部分冠（B对）适应证：有牙体缺损需修复但又非嵌体适应证时。